某地区人均每日摄入能量3300kcal，蛋白质110g以上，脂肪130g，其膳食结构类型属于
A. 东方膳食结构
B. 经济发达国家膳食结构
C. 日本膳食结构
D. 地中海膳食结构
E. 过渡型膳食结构

正确答案：B。经济发达国家膳食结构

解析：本题考查经济发达国家膳食结构。该地区人均每日摄入能量3300kcal，蛋白质110g以上，脂肪130g，以高能量、高脂肪、高蛋白质、低膳食纤维为主要特点。其膳食结构类型属于经济发达国家膳食结构（B对ACDE错）。